关于药品说明书和标签管理要求的说法，正确的有
A. 药品不良反应尚不清楚的，药品说明书中可不列【不良反应】项目
B. 药品说明书【不良反应】项目下应当包括孕妇、哺乳期和慢性疾病患者用药注意事项
C. 药品说明书【药品名称】项下应注明汉语拼音
D. 药品内标签包装尺寸过小无法标明所有内容的，内标签至少应当标明通用名称、规格、产品批号和有效期

正确答案：C、D。药品说明书【药品名称】项下应注明汉语拼音；药品内标签包装尺寸过小无法标明所有内容的，内标签至少应当标明通用名称、规格、产品批号和有效期

解析：本题考查药品标签和说明书管理。关于药品说明书和标签管理要求的说法，正确的有药品说明书【药品名称】项下应注明汉语拼音（C对）；药品内标签包装尺寸过小无法标明所有内容的，内标签至少应当标明通用名称、规格、产品批号和有效期（D对）。药品说明书【药品名称】按下列顺序列出：（1）通用名称：中国药典收载的品种，其通用名称应当与药典一致；或者与国家批准的该品种药品标准中的药品名称一致；药典未收载的品种，其名称应当符合药品通用名称命名原则。（2）商品名称：未批准使用商品名称的药品不列该项。（3）英文名称：无英文名称的药品不列该项。（4）汉语拼音。药品内标签是指直接接触药品包装的标签。内包装标签可根据其尺寸的大小，应当尽可能包含药品通用名称、适应症或者功能主治、规格、用法用量、贮藏、生产日期、生产批号、有效期、生产企业等内容。包装尺寸过小无法全部标明上述内容的，至少应当标注药品通用名称、规格、产品批号、有效期等内容。药品说明书【不良反应】（1）处方药应当实事求是地详细列出该药品不良反应，并按不良反应的严重程度、发生的频率或症状的系统性列出；尚不清楚有无不良反应的，可在该项下以“尚不明确”来表述（A错）。（2）预防用生物制品应包括接种后可能出现的偶然或者一过性反应的描述，以及对于出现的不良反应是否需要特殊处理建议。（3）非处方药在本项目下应当实事求是地详细列出该药品已知的或者可能发生的不良反应。并按不良反应的严重程度、发生的频率或症状的系统性列出。国家药品监督管理部门公布的该药品不良反应内容不得删减。同时，标注“不良反应”的定义。药品说明书中注意事项或禁忌的编写要点：安全剂量范围小的药品必须标明此栏，注意事项还包括孕妇、哺乳期、慢性病等特殊患者应注意的内容（B错），以及其他药品合用的禁忌等。